在甲型肝炎病程中哪期传染性最强
A. 潜伏期
B. 黄疸前期
C. 黄疸期
D. 恢复期
E. 慢性期

正确答案：B。黄疸前期